尘肺X线诊断标准中“q”阴影是指
A. 直径在1.5mm以下的类圆形小阴影
B. 直径在1.5～3mm的类圆形小阴影
C. 直径在3～10mm以下的类圆形小阴影
D. 宽度在1.5mm以下的不规则形小阴影
E. 宽度在1.5～3mm的不规则形小阴影

正确答案：B。直径在1.5～3mm的类圆形小阴影

解析：本题考查圆形小阴影的分类。圆形小阴影是矽肺最常见的X线表现形态，呈圆或近似圆形，边缘整齐或不整齐，直径小于10mm, 按直径大小分为p（＜1.5mm）、q（l.5～3.0mm）（B对ACDE错）、r（3.0～10mm）三种类型。